能全部通过八号筛，并含有能通过九号筛不少于95%的粉末是
A. 最粗粉
B. 粗粉
C. 中粉
D. 最细粉
E. 极细粉

正确答案：E。极细粉

解析：本题考查粉末等级。能全部通过八号筛，并含有能通过九号筛不少于95%的粉末是极细粉（E对）。极细粉：指能全部通过八号筛，并含能通过九号筛不少于95%的粉末。《中国药典》现行版本规定了六种粉末等级。最粗粉（A错）：指能全部通过一号筛，但混有能通过三号筛不超过20%的粉末；粗粉（B错）：指能全部通过二号筛，但混有能通过四号筛不超过40%的粉末；中粉（C错）：指能全部通过四号筛，但混有能通过五号筛不超过60%的粉末；细粉：指能全部通过五号筛，并含能通过六号筛不少于95%的粉末；最细粉（D错）：指能全部通过六号筛，并含能通过七号筛不少于95%的粉末。